仰卧位时前腹壁与胸骨下端到耻骨联合的连线大致在同一水平面上，称为
A. 腹部平坦
B. 腹部饱满
C. 腹部膨隆
D. 腹部低平
E. 腹部凹陷

正确答案：A。腹部平坦

解析：仰卧位时前腹壁与胸骨下端到耻骨联合的连线大致在同一水平面上，称为腹部平坦（A对）。腹部饱满为平卧时前腹壁稍高于肋缘与耻骨联合平面（B错）。腹部膨隆为平卧时前腹壁明显高于肋缘与耻骨联合的平面（C错）。腹部低平为平躺时腹部下陷，前腹壁稍低于肋缘与耻骨联合的平面（D错）。腹部凹陷为仰卧时前腹壁明显低于肋缘与耻骨联合的平面（E错）。